在肌紧张反射中，脊髓前角运动神经元属于
A. 感受器
B. 传入神经元
C. 神经中枢
D. 传出神经
E. 效应器

正确答案：C。神经中枢